病情未得到控制，出现全身黄染的感染是
A. 疖
B. 痈
C. 丹毒
D. 急性化脓性腱鞘炎
E. 气性坏疽

正确答案：E。气性坏疽

解析：气性坏疽（P119）（E对）即梭状芽胞杆菌所致的肌肉坏死或肌炎，发展急剧，预后严重，全身中毒症状明显，高热可达40℃，呼吸脉搏加快，可发生溶血性贫血、黄疸（梭状芽胞杆菌可产生α毒素，其主要是外毒素，具有卵磷脂酶活性，可引发溶血，继而发生溶血性黄疸）。急性化脓性腱鞘炎（D错）炎症较局限，一般不会引发黄疸。事实上，疖、痈、丹毒若未得到恰当处理均可能引起脓毒症，进一步出现全身黄染，不过气性坏疽病情更为严重，出现黄染的几率较大（ABC错）。